寒湿腰痛的主方是
A. 四妙丸
B. 左归丸
C. 右归丸
D. 甘姜苓术汤
E. 青娥丸

正确答案：D。甘姜苓术汤

解析：寒湿腰痛是因寒湿闭阻，滞碍气血，经脉不利导致的，治疗应用甘姜苓术汤散寒行湿，温经通络（D对）。四妙丸清热利湿，舒筋止痛，为湿热腰痛的代表方（A错）。左归丸滋补肾阴，濡养筋脉，为肾阴虚腰痛的代表方（B错）。右归丸补肾壮阳，温煦经脉，为肾阳虚腰痛的代表方（C错）。青娥丸适用于肾虚腰痛无明显阴阳偏盛者（E错）。